解决中药品种混乱和复杂问题的途径主要有
A. 力求一物一名，一名一物
B. 进行药材品种的本草考证
C. 开展药材栽培技术研究
D. 正确继承古人药材生产与使用经验
E. 开展药源普查，进行品种整理

正确答案：A、B、D、E。力求一物一名，一名一物；进行药材品种的本草考证；正确继承古人药材生产与使用经验；开展药源普查，进行品种整理

解析：本题考查的是解决中药品种混乱和复杂问题的途径。解决中药品种混乱和复杂问题的途径主要有力求一物一名，一名一物（A对）、进行药材品种的本草考证（B对）、正确继承古人药材生产与使用经验（D对）、开展药源普查，进行品种整理（E对）。解决中药品种混乱和复杂问题及发掘祖国药学遗产的途径有6条：（1）力求一物一名，一名一物； （2）正确继承古人药材生产和用药经验； （3）开展古方药物的品种考证； （4）查考地方志； （5）本草考证有助于自认资源的开发利用；（6）本草考证与现今药材品种相结合。